男，62岁。上腹部隐痛1年，进食后呕吐20天，呕吐物含有宿食。查体：贫血貌，消瘦，上腹部可见胃型，可闻及振水音。最可能的诊断是
A. 胃溃疡
B. 十二指肠溃疡合并幽门梗阻
C. 胃癌合并幽门梗阻
D. 慢性胃炎
E. 胰腺炎

正确答案：C。胃癌合并幽门梗阻